心尖区舒张期杂音考虑的疾病是
A. 主动脉瓣狭窄
B. 肺动脉瓣狭窄
C. 动脉导管未闭
D. 二尖瓣狭窄
E. 室间隔缺损

正确答案：D。二尖瓣狭窄

解析：心尖部杂音主要见于二尖瓣病变，舒张期杂音考虑二尖瓣狭窄（D对），收缩期杂音考虑二尖瓣关闭不全。主动脉瓣狭窄（A错）时，主动脉瓣区听到响亮粗糙、音调较高时限长的吹风样喷射性收缩期杂音。肺动脉瓣狭窄（B错）主要体征是在胸骨左缘第2肋骨处可听到响亮粗糙的喷射性吹风样收缩期杂音。动脉导管未闭（C错）典型的体征是胸骨左缘第2肋间听到响亮的连续性机器样杂音。室间隔缺损（E错）典型体征为胸骨左缘3、4肋间有粗糙收缩期杂音。